某研究组调查得甲县食管癌死亡率p＝43.12/10万，乙县食管癌死亡率p＝39.46/10万，经标准化后，甲县标准化食管癌死亡率p'＝45.23/10万，乙县标准化食管癌死亡率p'＝49.87/10万。要对比两县食管癌死亡总水平，进行率的标准化，目的是消除两县
A. 总死亡率的影响
B. 总人口数不同的影响
C. 人口年龄构成不同的影响
D. 食管癌死亡构成不同的影响
E. 年龄别食管癌死亡水平不同的影响

正确答案：C。人口年龄构成不同的影响